关于破伤风，正确的描述是
A. 颈部肌肉强烈收缩最早出现
B. 光线不能诱发全身肌肉抽搐
C. 严重者神志不清
D. 可出现尿潴留
E. 不会发生骨折

正确答案：D。可出现尿潴留

解析：破伤风的典型症状是在肌紧张性收缩的基础上，阵发性强烈痉挛，通常最先受影响的肌群是咬肌（A错）。破伤风症状可由轻微刺激，如声、光（B错）、接触、饮水等诱发。破伤风病人症状发作时神志清楚（C错）。强烈的肌痉挛，可使肌断裂，甚至发生骨折（E错）。膀胱括约肌痉挛可引起尿潴留（D对）。